部分地区目前结核患病率降低，不再用拍胸片来普查结核。下列哪项说法不正确
A. 拍胸片成本高
B. 消耗人力大
C. 消耗物力大
D. 查出病人少
E. 效益高

正确答案：E。效益高

解析：本题考查普查的缺点。普查的缺点包括：①不适用于患病率低且无简便易行诊断手段的疾病，会导致普查效益低（E错，为本题正确答案）；②工作量大，因此不易细致，难免存在漏查；③调查工作人员涉及面广，掌握调查技术和检查方法的熟练程度不一，对调查项目的理解往往很难统一和标准化，较难保证调查质量；④耗费的人力、物力资源一般较大，费用往往较高。